关于片剂包衣目的的说法，错误的是
A. 隔绝空气，提高药物稳定性
B. 加速片剂的崩解
C. 掩盖药物的不良气味
D. 改变药物释放速度
E. 改善外观，提高辨识度

正确答案：B。加速片剂的崩解

解析：本题考查片剂包衣的目的。片剂包衣的目的：①隔绝空气，避光，防潮，提高药物的稳定性（A对）。②掩盖药物的不良气味（C对），增加患者的顺应性。③控制药物在肠道内定位释放。包肠溶衣可避免药物对胃的刺激，防止胃酸或胃酶对药物的破坏。包结肠定位肠溶衣可在结肠定位释放药物，治疗结肠部位疾病。④包缓释或控释衣，改变药物释放速度（D对），减少服药次数，降低不良反应。⑤隔离有配伍禁忌的成分，避免相互作用，有助复方配伍。⑥改善外观，使片剂美观，且便于识别（E对）（B错，为本题正确答案）。